某县医院对其配制的医院制剂A，可以采取的服务措施是
A. 将A销售给药品经营企业
B. 在医院网站上对A进行广告宣传
C. 通过互联网交易方式销售
D. 将A的价格与其他药品一起进行公示
E. 应外地患者要求，直接邮寄给患者A

正确答案：D。将A的价格与其他药品一起进行公示

解析：本题考查的是医疗机构制剂的定义及特征。某县医院对其配制的医院制剂A，可以采取的服务措施是将A的价格与其他药品一起进行公示（D对）。医疗机构制剂的定义及特征：《医疗机构制剂注册管理办法（试行）》（局令第20号）第3条规定：医疗机构制剂，是指医疗机构根据本单位临床需要经批准而配制、自用的固定处方制剂。《药品管理法》规定，医疗机构配制制剂，应当经所在地省、自治区、直辖市人民政府药品监督管理部门批准，取得医疗机构制剂许可证。无医疗机构制剂许可证的，不得配制制剂。医疗机构配制的制剂，应当是本单位临床需要而市场上没有供应的品种，并应当经所在地省、自治区、直辖市人民政府药品监督管理部门批准；但是，法律对配制中药制剂另有规定的除外。医疗机构制剂具有如下特征：①双证管理。医疗机构获得《医疗机构制剂许可证》后，取得配制制剂的资格；如果要进行某种制剂的配制，还必须取得相应制剂的批准文号（法律对配制中药制剂另有规定的除外）。②品种补缺。医疗机构制剂仅限于临床需要而市场上没有供应的品种，方便临床使用。③医院自用为主。医疗机构制剂凭执业医师或者执业助理医师的处方在本单位内部使用（E错），并与《医疗机构执业许可证》所载明的诊疗范围一致。医疗机构配制的制剂不得在市场上销售（AC错），不得发布医疗机构制剂广告（B错）。特殊情况下，经国务院药品监督管理部门或者省级药品监督管理部门批准，可在指定的医疗机构之间调剂使用。④药剂科自制。医疗机构制剂只能由医院的药学部门配制，其他科室不得配制供应制剂。⑤质量检验合格。医疗机构制剂需按规定进行质量检验，质量检验一般由医疗机构的药检室负责，检验合格后，凭医师处方使用。